初孕妇，妊娠39周，剧烈持续腹痛4小时入院。贫血貌，血压130/80mmHg，脉搏120次/分，子宫硬，不松弛，有局限性压痛，胎位不清，胎心110次/分，阴道少量流血，肛查宫口未开。此时最恰当的处理应是
A. 输血输液
B. 静脉滴注缩宫素引产
C. 给予镇静药等待产程发动
D. 剖宫产结束分娩
E. 以上都不是

正确答案：D。剖宫产结束分娩

解析：该患者剧烈持续性腹痛，出现贫血貌，脉搏增快，子宫硬，宫缩间歇时不能松弛，胎位扪不清，宫口未开（Ⅲ度胎盘早剥可出现腹痛，面色苍白、四肢湿冷、脉搏细数、血压下降等休克症状，腹部检查见子宫硬如板状，宫缩间歇时不能松弛，胎位扪不清），故可能诊断是Ⅲ度胎盘早剥。但孕妇宫口未开，不能立即分娩，此时最恰当的处理应是行剖宫产结束分娩（D对CE错）。输血输液（A错）是为预防因失血过多导致休克。静脉滴注缩宫素引产（P189）（B错）适用于协调性宫缩乏力、宫口扩张≥3cm、胎心良好、胎位正常、头盆相称者。